蒙脱石散用多少水分散
A. 10ml
B. 50ml
C. 100ml
D. 200ml
E. 300ml

正确答案：B。50ml

解析：本题考查蒙脱石散的用法用量。一般取3g蒙脱石药，使用50ml（B对）温水，搅匀后服用。